患儿，5周岁。两周前曾患上感，目前不规则发热，易疲倦，脸色略苍白。查体发现：心率增快，心尖部第一心音减弱，并可闻及早搏，心电检查：P-R间期延长，ST段下移，实验室检查：C反应蛋白增高。该患儿首选药物是什么
A. 水杨酸制剂
B. 洋地黄类药物
C. 地塞米松制剂
D. 镇静剂
E. 抗生素

正确答案：C。地塞米松制剂

解析：肾上腺糖皮质激素 通常不主张使用，主要用于心源性休克、致死性心律失常（Ⅲ°房室传导阻滞、室性心动过速）等严重病例的抢救（C对）。患儿两周前有上感病史，现出现心功能不全等症状，且心率加快，脸色苍白，有休克的风险，应当使用地塞米松防止休克。水杨酸制剂具有较好的解热镇痛及抗风湿有较强的解热、镇痛作用，常与其他解热镇痛药配成复方，用于头痛、牙痛、肌肉痛、神经痛、痛经及感冒发热等（A错）。洋地黄类药物以心力衰竭为主要适应症。对于心腔扩大舒张期明显增加的慢性充血性心力衰竭效果较好。同时伴有房颤则是应用洋地黄最好指证（B错）。镇静剂是指可减少某些器官或组织活性，抑制中枢神经系统以起镇静作用的药物。大剂量时可引起睡眠和全身麻醉。它有助于缓解人们的抑郁和焦虑情绪，常被用来治疗精神疾病（D错）。根据检查结果可以在处理急症后合理应用抗生素（E错）。